生理性胎黄，黄疸出现的时间是
A. 出生后2周
B. 出生后2～3天
C. 出生后6～7天
D. 出生后24小时内
E. 出生后4～5天

正确答案：B。出生后2～3天

解析：生理性胎黄是指婴儿出生后2～3天出现黄疸（B对）。病理性胎黄出现时间早，在生后24小时内出现（D错）。